前庭神经节内的感觉神经元属
A. 双极神经元
B. 假单极神经元
C. 多极神经元
D. 联络神经元
E. 中间神经元

正确答案：A。双极神经元

解析：前庭神经节由双极感觉神经元（A对）组成其周围突穿内耳道底，分布于内耳的椭圆囊斑、球囊斑和壶腹峭中的毛细胞，中枢突组成前庭神经，经内耳门入颅，在脑桥小脑三角处，经延髓脑桥沟外侧部入脑，终止于前庭神经核群和小脑等部，传导平衡觉。